从切牙孔至腭垂全部裂开属于以下哪项的严重情况
A. 唇裂
B. 腭裂
C. 颌裂
D. 下颌裂
E. 斜面裂

正确答案：B。腭裂

解析：腭裂严重者从切牙孔至腭垂（悬雍垂）全部裂开。掌握“腭部与舌的发育”知识点。